7-羟基香豆素的1HNMR谱中H-4信号是
A. δ6．1～6．4
B. δ7．3～7．4
C. δ6．8～6．9
D. δ7．5～8．3
E. δ3．9～4．0

正确答案：D。δ7．5～8．3